引流根尖周组织炎症渗出物，也是急性根尖周炎最有效的应急处理措施的是
A. 牙髓切断术
B. 牙髓摘除术
C. 根管治疗术
D. 根尖诱导成形术
E. 开髓引流术

正确答案：E。开髓引流术

解析：开髓引流术：引流根尖周组织炎症渗出物，降低压力，缓解剧痛，是急性根尖周炎最有效的应急处理措施。掌握“急症处理”知识点。